可用于静脉注射脂肪乳的乳化剂是
A. 阿拉伯胶
B. 西黄蓍胶
C. 豆磷脂
D. 脂肪酸山梨坦
E. 十二烷基硫酸钠

正确答案：C。豆磷脂

解析：本题考查注射剂常用附加剂。静脉用脂肪乳常用的乳化剂有卵磷脂、豆磷脂（C对）、普郎尼克F68等数种。阿拉伯胶（A错）和西黄蓍胶（B错）为天然高分子乳化剂。脂肪酸山梨坦（D错）和十二烷基硫酸钠（E错）为表面活性剂类的乳化剂。